肠梗阻患者保守治疗期间，病情进展需手术的最主要指征是
A. 肠鸣音减弱或消失
B. 腹痛加重
C. 呕吐频繁和量大
D. 腹膜刺激征加重
E. 腹胀程度加重

正确答案：E。腹胀程度加重

解析：急性肠梗阻常并发腹膜炎，腹胀加重是病情恶化的重要标志（E对），腹膜刺激征是腹膜炎的标志性体征。在绞窄性肠梗阻晚期，患者一般情况差，腹膜刺激征反而减轻，但仍需手术治疗。故答E 而不是D， 很多医考参考书将答案错为D， 参阅九版外科学P331 （D错）。肠鸣音减弱或消失见于麻痹性肠梗阻（A错），腹痛加重见于肠蠕动增强（B错），呕吐频繁提示高位肠梗阻（C错）。